在制备蛋白、多肽类药物的注射用无菌粉末（冷冻干燥剂）时，常常需加入填充剂，最常用的填充剂是
A. 乙醇
B. 丁醇
C. 辛醇
D. 甘露醇
E. 硬脂醇

正确答案：D。甘露醇

解析：本题考查注射剂常用附加剂。在制备蛋白、多肽类药物的注射用无菌粉末（冷冻干燥剂）时，常常需加入填充剂，最常用的填充剂是甘露醇（D对）。糖和多元醇可增加蛋白质药物在水中的稳定性。常用的糖类与多元醇如甘露醇、山梨醇、蔗糖、葡萄糖、乳糖、海藻糖和右旋糖酐等，但以甘露醇最为常用。